4岁男孩，发育正常。以下情况与其年龄相符的是
A. 手部精细动作（如写字、画图等）基本发育完善
B. 躯干的增长速度最快
C. 处于童年期
D. 处于幼儿前期
E. 身高在90cm左右

正确答案：E。身高在90cm左右